酸性最强的化合物是
A. 7，4'-二羟基
B. 7-羟基
C. 5-羟基
D. 4'-羟基
E. 一般酚羟基

正确答案：A。7，4'-二羟基

解析：本题考查的是黄酮类化合物酸性比较。酸性最强的化合物是7，4'-二羟基（A对）。由于酚羟基数目及位置不同，酸性强弱也不同。以黄酮为例，其酚羟基酸性强弱顺序依次为：7，4'-二羟基＞7或4'-羟基（BD错）＞一般酚羟基（E错）＞5-羟基（C错）。